下列关于氟中毒的论述中错误的是
A. 发病有明显的性别差异
B. 氟斑牙多见于恒牙
C. 从非病区搬入的居民比当地居民易患病
D. 随年龄增加患氟骨症的病人增多
E. 氟骨症多见于16岁以后的成年人

正确答案：A。发病有明显的性别差异

解析：本题考查地方性氟中毒。地方性氟中毒是由于一定地区的环境中氟元素过多，而致生活在该环境中的居民经饮水、食物和空气等途径长期摄入过量氟所引起的以氟骨症和氟斑牙为主要特征的一种慢性全身性疾病。地方性氟中毒与年龄有密切关系，氟斑牙主要发生在正在生长发育中的恒牙（B对），乳牙一般不发生氟斑牙。而氟骨症发病主要在成年人（E对），发生率随着年龄增长而升高（D对），且病情严重。地方性氟中毒的发生一般无明显性别差异（A错，为本题正确答案）。但是，由于生育、授乳等因素的影响，女性的病情往往较重，特别是易发生骨质疏松软化，而男性则以骨质硬化为主。非病区迁入者发病时间一般较病区居民短（C对），迁入重病区者，可在1～2年内发病，且病情严重。